风寒感冒适用的治疗法则是
A. 正治法
B. 从治法
C. 反治法
D. 补虚法
E. 反佐法

正确答案：A。正治法

解析：正治法：适用于疾病的征象与本质一致的病证。风寒感冒为外感风寒邪气而发，表现恶寒发热、项背强几几等寒性症状，治疗应使用辛温解表的药物，属于正治法。（A对）。反治（B错）是指顺从病证的外在假象而治的一种治疗原则。由于采用的方药性质与病证中假象的性质相同，故又称为"从治"（C错）。补虚法（D错）属于虚则补之，指虚损行病证，应用补益作用的方药来治疗，以补虚治疗虚证。反佐法（E错）属于药物的配伍原则，与治法相混淆了。